关节内骨折最常见的并发症是
A. 骨折不愈合
B. 创伤性关节炎
C. 缺血性骨坏死
D. 骨化性肌炎
E. 骨折畸形愈合

正确答案：B。创伤性关节炎

解析：关节内骨折，关节面遭到破坏，又未能准确复位，骨愈合后使关节面不平整，长期磨损易引起创伤性关节炎（B对）（P617）。骨折不愈合（A错）多由于骨折端间嵌夹较多软组织，开放性骨折清创时去除的骨片较多而造成骨缺损，多次手术对骨的血液供应破坏较大及内固定失败等因素所致，与是否为关节内骨折没有明确关系（P627）。缺血性骨坏死（C错）是由于骨折使某一骨折端的血液供应被破坏，而发生该骨折端缺血性坏死，常见得有腕舟状骨骨折后近侧骨折端缺血性坏死、股骨颈骨折后股骨头缺血性坏死（P617）。骨化性肌炎（D错）又称损伤性骨化，由于关节扭伤、脱位或关节附近骨折，骨膜剥离形成骨膜下血肿，处理不当使血肿扩大，血肿机化并在关节附近软组织内广泛骨化，造成严重关节活动功能障碍，特别多见于肘关节，如肱骨髁上骨折，反复暴力复位或骨折后肘关节伸屈活动受限而进行的强力反复牵拉所致而并不是关节内骨折并发症（P617）。骨折畸形愈合（E错）可能由于骨折复位不佳、固定牢固或过早拆除固定，受肌肉牵拉、肢体重量和不恰当负重的影响所致（P627）。